伴有淋巴结转移的Ⅱ期乳腺癌患者宜施行
A. 乳腺癌改良根治术
B. 乳腺癌根治术
C. 乳腺癌扩大根治术
D. 单纯乳房切除术
E. 肿物切除术

正确答案：A。乳腺癌改良根治术